女性，64岁，绝经14年，阴道少量出血3次。查体：腹膨隆，如足月妊娠，腹水征（-），B超示：巨大肿物40cm×50cm×30cm，囊性，多房性。体重、食欲、二便均无变化。本例最可能为卵巢的
A. 浆液性囊腺瘤
B. 粘液性囊腺瘤
C. 皮样囊肿
D. 卵泡膜细胞瘤
E. 透明细胞癌

正确答案：B。粘液性囊腺瘤

解析：该患者为老年妇女，绝经后出现少量阴道出血，查体：腹膨隆，如足月妊娠，腹水征（﹣）（卵巢良性肿瘤检查见腹部膨隆，包块活动度差，叩诊实音，无移动性浊音）。B超示：巨大肿物40cm×50cm×30cm大，囊性，多房性（黏液囊腺瘤多为单侧，圆形或卵圆形，体积较大，切面常为多房），体重、食欲、二便均无变化（该患者肿物巨大，且体重、食欲、二便均无变化，怀疑为卵巢良性肿瘤），最可能为黏液性囊腺瘤（B对）。浆液性囊腺瘤（A错）多为单侧，囊性，球形，大小不等，与该病例中的巨大肿物不符。皮样囊肿（C错）属良性肿瘤，可发生于任何年龄，以20～40岁居多。多为单侧，中等大小，呈圆形或卵圆形，多为单房，腔内充满油脂和毛发，有时可见牙齿或骨质。卵泡膜细胞瘤（D错）临床特点为实性肿物。透明细胞癌（八年制第2版妇产科学P346）（E错）为卵巢恶性肿瘤，患者均为成年妇女，平均年龄48～58岁，呈囊实性，单侧多，较大，而根据患者临床表现，考虑为良性肿瘤。